餐前服用，可以充分附着于胃壁黏膜的药品是
A. 复方铝酸铋片
B. 二甲双胍片
C. 甲氧氯普胺片
D. 瑞舒伐他汀片
E. 维生素C

正确答案：A。复方铝酸铋片

解析：本题考查药品服用的适宜时间。复方铝酸铋（A对）为胃黏膜保护药，适宜于餐前服用，可以充分附着于胃壁黏膜。二甲双胍（B错）宜于餐中服用，可以减少对胃肠道的刺激和不良反应。甲氧氯普胺（C错）为促胃动力药，于餐前服用利于促进胃蠕动，帮助消化。瑞舒伐他汀（D错）宜在睡前服用，因为肝脏合成胆固醇峰期多在夜间，晚餐后服药有助于提高疗效。维生素C（E错）任何时间服用都可以。